以下关于钉洞固位形的说法哪个是错误的
A. 钉固位力的大小主要取决于钉洞深度
B. 固位钉的直径约为1mm
C. 固位钉可分为粘固式，螺纹式，楔入式
D. 其中楔入式固位力最好
E. 钉洞应位于坚固的牙本质上

正确答案：D。其中楔入式固位力最好

解析：本题考查钉洞固位形。关于钉洞固位形的说法错误的是其中楔入式固位力最好（D错，为本题的正确答案）。根据钉的固位方式，可分为粘固式，螺纹式，楔入式（C对），其中螺纹式是主动固位，固位力最好，不是楔入式。钉固位力的大小取决于于钉洞的深度（A对），越深固位越好，但是要主要保护牙髓，一般深1.5mm，根据需要可增加至2mm。钉洞的直径约1mm（B对）左右，太细钉容易折断，太粗牙齿容易折断。钉洞应位于坚固的牙本质上（E对），这个位置远离牙髓，也不容易造成牙釉质折裂。